体温下降期热代谢的特点是
A. 产热大于散热
B. 散热大于产热
C. 产热和散热平衡
D. 产热增加
E. 散热增加

正确答案：B。散热大于产热

解析：在体温下降期时，由于激活物、EP及发热介质的消除，体温调节中枢的调定点返回到正常水平，散热增强，产热减少，散热大于产热（B对）是此期热代谢的特点。产热和散热平衡（C错）是高热期的热代谢特点。产热大于散热（A错）是体温上升期的热代谢特点。